上颌结节阻滞麻醉如针头污染可造成的间隙感染为
A. 眶下间隙
B. 颞下间隙
C. 翼颌间隙
D. 咬肌间隙
E. 颌下间隙

正确答案：B。颞下间隙

解析：本题考查口腔颌面部间隙感染。上颌结节阻滞麻醉如针头污染可造成的间隙感染为颞下间隙（B对）。颞下间隙：位于颅中窝底。该间隙中的脂肪组织、上颌动静脉、翼静脉丛、三叉神经上、下颌支的分支分别与颞、翼下颌、咽旁、颊、翼腭等间隙相通；还可借眶下裂、卵圆孔和棘孔分别与眶内、颅内通连，借翼静脉丛与海绵窦相通。眶下间隙（A错）：【感染来源】多来自上颌尖牙、第一前磨牙和上颌切牙的根尖化脓性炎症和牙槽脓肿；此外，可因上颌骨骨髓炎的脓液穿破骨膜，或上唇底部与鼻侧的化脓性炎症扩散至眶下间隙引起。翼颌间隙（C错）：【感染来源】常见为下颌智齿冠周炎及下颌磨牙根尖周炎症扩散所致；下牙槽神经阻滞麻醉时消毒不严或拔下颌第三磨牙时创伤过大，也可引起翼下颌间隙感染；此外，相邻间隙，如颞下间隙、咽旁间隙炎症也可波及。咬肌间隙（D错）：【感染来源】主要来自下颌智齿冠周炎，下颌磨牙的根尖周炎、牙槽脓肿，亦可因相邻间隙如颞下间隙感染的扩散，偶有因化脓性腮腺炎波及者。颌下间隙（E错）：【感染来源】多见于下颌智齿冠周炎、下颌后牙根尖周炎、牙槽脓肿等牙源性感染或下颌下淋巴结炎的扩散。化脓性下颌下腺炎有时亦可继发下颌下间隙感染。